臁疮湿热下注的治法是
A. 清热解毒，养阴活血
B. 清热利湿，活血通络
C. 益气活血，清热解毒
D. 清热利湿，和营解毒
E. 活血化瘀，和营消肿

正确答案：D。清热利湿，和营解毒

解析：臁疮湿热下注证表现为小腿青筋怒涨，局部发痒，红肿，疼痛，继则破溃，滋水淋漓，疮面腐暗；伴口渴、便秘、小便黄赤；苔黄腻，脉滑数，此时以湿热为主，当清热利湿（A、C、E错）；此时有红肿疼痛，因“营气不从，逆于肉里”而形成，而瘀血的表现不明显（B错），当和营解毒（D对）。